正常成人时间肺活量第1秒末呼出气量占肺活量的百分比是
A. 0.6
B. 0.63
C. 0.8
D. 0.96
E. 0.99

正确答案：C。0.8